下列哪项属于脑炎常见面容
A. 伤寒面容
B. 苦笑面容
C. 满月面容
D. 病危面容
E. 面具面容

正确答案：A。伤寒面容

解析：伤寒面容（A对）表现为表情淡漠，反应迟钝，呈无欲状态，见于伤寒、脑脊髓膜炎、脑炎等高热衰弱患者。苦笑面容（B错）表现为发作时牙关紧闭，面肌痉挛，呈苦笑状，见于破伤风。满月面容（C错）表现为面圆如满月，皮肤发红，常伴痤疮和小须，见于库欣综合征及长期应用肾上腺皮质激素的患者。病危面容（D错）表现为面容枯槁，面色苍白，表情淡漠，目光无神，眼睛凹陷。面具面容（E错）表现为面部呆板、无表情，似面具样，见于震颤麻痹等。